根据急性毒性试验结果放弃某种受试物用于食品，不再继续其他毒理学试验，表明其LD₅₀
A. 大于人的可能摄入量的100倍
B. 大于人的可能摄入量的50倍
C. 小于人的可能摄入量的10倍
D. 小于人的可能摄入量的50倍
E. 小于人的可能摄入量的100倍

正确答案：E。小于人的可能摄入量的100倍

解析：本题考查急性毒性试验的相关内容。根据急性毒性试验结果放弃某种受试物用于食品，不再继续其他毒理学试验，表明其LD₅₀小于人的推荐（可能）摄入量的100倍（E对ABCD错）。